正确的是
A. 起于胸腰筋膜和下位8个肋骨外面
B. 腱膜形成腹股沟韧带
C. 参与构成腹直肌鞘前、后层
D. 肌纤维斜向前下
E. 腱膜独立构成联合腱

正确答案：C。参与构成腹直肌鞘前、后层

解析：腹内斜肌起自胸腰筋膜、髂嵴和腹股沟韧带外侧1/2，而非胸腰筋膜和下位8个肋骨外面（A错）。腱膜形成腹股沟韧带（B错）的是腹外斜肌，而非腹内斜肌。腹内斜肌参与构成腹直肌鞘前、后层（C对），肌纤维垂直向上，而非斜向前下（D错），其腱膜与腹横肌相应腱膜构成联合腱，而非独立构成联合腱（E错）。